用药后不能马上饮水的情形有
A. 高血压患者服用硝苯地平控释片
B. 心绞痛发作患者舌下含服硝酸甘油片
C. 口腔炎患者使用复方氯已定含漱液
D. 中暑患者服用藿香正气软胶囊
E. 发热患者使用阿司匹林泡腾片

正确答案：B、C。心绞痛发作患者舌下含服硝酸甘油片；口腔炎患者使用复方氯已定含漱液

解析：本题考查各种剂型的正确使用。用药后不能马上饮水的情形有：心绞痛发作患者舌下含服硝酸甘油片（B对）；口腔炎患者使用复方氯已定含漱液（C对）。舌下片含后30min内不宜吃东西或饮水。含漱剂含漱后不宜马上饮水和进食，以保持口腔内药物浓度。控释一般应整片或整丸吞服，严禁嚼碎和击碎分次服用（A错）。软胶囊在最新版考试指导中未明确要求（D错）。泡腾片一般宜用100～150ml凉开水或温水浸泡，可迅速崩解和释放药物，应待完全溶解或气泡消失后再饮用，严禁直接服用或口含（E错）。